药师连续几次以上未按照规定审核抗菌药物处方与医嘱，或者发现处方不适宜、超常处方未进行干预且无正当理由的，取消其抗菌药物调剂资格
A. 1次
B. 2次
C. 3次
D. 4次
E. 5次

正确答案：C。3次

解析：药师连续3次以上未按照规定审核抗菌药物处方与医嘱，或者发现处方不适宜、超常处方未进行干预且无正当理由的，取消其抗菌药物调剂资格掌握“抗菌药物临床应用、监督及法律责任”知识点。